职业病诊断鉴定委员会组成人员应当遵守以下要求，但除外
A. 客观、公正地进行诊断鉴定
B. 不得私下接触当事人
C. 不得收取当事人的财物或者其他好处
D. 与当事人有利害关系的，应当回避
E. 应当实行封闭式诊断鉴定

正确答案：E。应当实行封闭式诊断鉴定